关于膀胱三角的描述，错误的是
A. 是膀胱肿瘤、结核好发部位
B. 在膀胱底的内面
C. 缺少粘膜下层
D. 粘膜与肌层疏松相连
E. 位于两输尿管口与尿道内口连线之间

正确答案：D。粘膜与肌层疏松相连

解析：膀胱三角位于膀胱底内面（B对）左、右输尿管口和尿道内口之间（E对），黏膜与肌层紧密连接（D错，为本题正确答案），缺少黏膜下层组织（C对），始终保持平滑，是肿瘤、结核和炎症的好发部位（A对），故膀胱镜检查时应特别注意。